盐酸吗啡的鉴别方法是
A. 加水与0.4%氢氧化钠溶液使溶解，加硫酸铜试液1滴，即生成草绿色沉淀
B. 加水1ml溶解后，加硝酸5滴，即显红色，渐变为淡黄色
C. 加甲醛-硫酸试液1滴，即显紫堇色
D. 加硫酸1滴溶解后，加重铬酸钾的结晶1小粒，周围即显紫色
E. 加水5ml溶解后，缓缓滴入微温的碱性酒石酸铜试液中，即生成红色沉淀

正确答案：C。加甲醛-硫酸试液1滴，即显紫堇色

解析：本题考查常用的药品鉴别方法。盐酸吗啡的鉴别方法是加甲醛-硫酸试液1滴，即显紫堇色（C对）。 Marquis反应为含酚羟基的异喹啉类生物碱的特征反应。该类药物遇甲醛-硫酸试液可生成具有醌式结构的有色化合物。鉴别方法：取本品约1mg，加甲醛-硫酸试液1滴，即显紫堇色。加水5ml溶解后，缓缓滴入微温的碱性酒石酸铜试液中，即生成红色沉淀（E错）是《中国药典》中规定的葡萄糖等药物的鉴别方法。